女35岁，左上5缺失，左上46固定修复，一个月脱落，检查46全冠预备体完好，高度约4mm，颌间隙2mm，轴面聚合角度＞20°，冠边缘位于颈部龈下0.5mm，无肩台。脱落的原因
A. 基牙支持力不足
B. 颈部边缘过低
C. 颈部边缘设计错误
D. 轴面聚合角度过大
E. 待回忆

正确答案：D。轴面聚合角度过大

解析：本题考查修复体可能出现的问题。患者左上5缺失，左上46固定修复，一个月脱落，检查46全冠预备体完好，轴面聚合角度＞20°（提示轴面聚合角过大，正常为2°～5°），可得知该修复体脱落的原因为轴面聚合角度过大（D对）。基牙支持力不足（A错）可引起基牙松动。颈部边缘过低（B错）、颈部边缘设计错误（C错）、待回忆（E错）与修复体的脱落联系较小。